下列疾病除哪项外均可见到周围血管征
A. 主动脉瓣关闭不全
B. 发热
C. 贫血
D. 甲亢
E. 主动脉瓣狭窄

正确答案：E。主动脉瓣狭窄

解析：周围血管征包括枪击音、水冲脉、Duroziez双重杂音以及毛细血管搏动征，主要见于脉压增大的疾病如主动脉瓣关闭不全（A对）、发热（B对）、贫血（C对）、甲亢（D对）。主动脉瓣狭窄（E错，为本题正确答案）患者表现为脉压减小，不会出现周围血管征。